线粒体内膜复合物V的F₀
A. 含有寡霉素敏感蛋白
B. 具有ATP合酶活性
C. 结合GDP后发生构象改变
D. 存在单加氧酶
E. 存在H⁺通道

正确答案：E。存在H⁺通道

解析：线粒体内膜复合物V，即为ATP合酶。含F₁和F₀两个功能结构域。F₀的大部分结构嵌入线粒体内膜中，组成H⁺通道（E对），用于质子的回流；F₁为线粒体基质侧的蘑菇头状突起，具有ATP合酶活性（B错），可催化ATP合成，F₁由α₃β₃γδε亚基复合体和OSCP、IF₁等亚基组成，OSCP为寡霉素敏感蛋白（A错）。结合GDP后发生构象改变（C错）的为GTP酶活性。单加氧酶（D错）主要存在于微粒体中，并不在线粒体中出现。